下列中药中呈菱状方形或短圆柱形，两端平行倾斜，表面绿棕色，平滑有光泽，气微，味微苦的是
A. 决明子
B. 乌梅
C. 草果
D. 沙苑子
E. 枸杞子

正确答案：A。决明子

解析：本题考查的是决明子药材的性状鉴别。下列中药中呈菱状方形或短圆柱形，两端平行倾斜，表面绿棕色，平滑有光泽，气微，味微苦的是决明子（A对）。决明子：【性状鉴别】药材决明略呈菱状方形或短圆柱形，两端平行倾斜。表面绿棕色或暗棕色，平滑有光泽。一端较平坦、另端斜尖，背腹面各有1条突起的棱线，棱线两侧各有1条斜向对称而色较浅的线形凹纹。质坚硬，不易破碎。种皮薄，子叶2，黄色，呈“S”形折曲并重叠。气微，味微苦。乌梅（B错）：【性状鉴别】药材呈类球形或扁球形。表面乌黑色或棕黑色，皱缩不平，基部有圆形果梗痕。果核坚硬，椭圆形，棕黄色，表面有凹点；种子扁卵形，淡黄色。气微，味极酸。草果（C错）：【性状鉴别】呈长椭圆形，具三钝棱。表面灰棕色至红棕色，具纵沟及棱线，顶端有圆形突起的柱基，基部有果梗或果梗痕。果皮质坚韧，易纵向撕裂。剥去外皮，中间有黄棕色隔膜，将种子团分成3瓣，每瓣有种子多为8～11粒。种子呈圆锥状多面体；表面红棕色，外被灰白色膜质的假种皮，种脊为一条纵沟，尖端有凹状的种脐；质硬，胚乳灰白色。有特异香气，味辛、微苦。沙苑子（D错）：【性状鉴别】药材略呈圆肾形而稍扁。表面绿褐色至灰褐色，光滑，边缘一侧微凹处具圆形种脐。质坚硬，不易破碎。除去种皮，有淡黄色子叶2片，胚根弯曲。气微，味淡，嚼之有豆腥味。枸杞子（E错）：【性状鉴别】药材呈类纺锤形或椭圆形。表面红色或暗红色。顶端有小突起状的花柱痕，基部有白色的果梗痕。果皮柔韧，皱缩；果肉肉质，柔润。种子20～50粒，类肾形，扁而翘，表面浅黄色或棕黄色。气微，味甜。